老年人由于牙缝较宽、牙稀松，牙根暴露，应使用哪些器具清除食物残渣及牙菌斑
A. 牙间刷
B. 牙签
C. 牙线
D. 冲牙器
E. 以上均可使用

正确答案：E。以上均可使用

解析：老年人由于牙缝较宽、牙稀松，牙根暴露，应使用间隙刷、牙线和牙签清除存留在邻面及牙根面的食物残渣及牙菌斑。有条件时可选用冲牙器。掌握“老年人口腔保健”知识点。